T细胞分化、发育、成熟的场所是
A. 脾脏
B. 胸腺
C. 骨髓
D. 淋巴结
E. 肝脏

正确答案：B。胸腺